在下列生物碱混合物的酸水中逐渐加碱，使pH由低到高，每调一次pH，用氯仿萃取一次，最先萃取出来的是
A. 苦参碱
B. 麻黄碱
C. 小檗碱
D. 乌头碱
E. 秋水仙碱

正确答案：E。秋水仙碱

解析：本题考查的是生物碱的酸碱性。在下列生物碱混合物的酸水中逐渐加碱，使pH由低到高，每调一次pH，用氯仿萃取一次，最先萃取出来的是秋水仙碱（E对）。根据pKₐ值大小，可将生物碱分为：①强碱（pKₐ＞11），如季铵碱、胍类生物碱；②中强碱（pKₐ7～11），如脂胺、脂杂环类生物碱；③弱碱（pKₐ2～7），如芳香胺、N-六元芳杂环类生物碱；④极弱碱（pKₐ＜2），如酰胺、N-五元芳杂环类生物碱。秋水仙碱（E对）（pKₐ1.84）属于酰胺碱，为极弱碱，碱性最弱，故最先萃取出来。苦参碱（A错）为叔胺碱，碱性较强。麻黄碱（B错）（pKₐ9.58）为仲胺碱，碱性较强。小檗碱（C错）（pKₐ11.5）为季铵碱，属于强碱。乌头碱（D错）为双酯型生物碱，属于芳香胺碱，为弱碱。